瞳子髎归
A. 足太阳膀胱经
B. 足少阳胆经
C. 手太阳小肠经
D. 手少阴心经
E. 手少阳三焦经

正确答案：B。足少阳胆经

解析：本题考查穴位的归经，记忆即可。瞳子髎归属足少阳胆经（B对）。